《执业医师法》规定对考核不合格的医师，卫生行政部门可以责令其暂停执业活动，并接受培训和继续医学教育。暂停期限是3个月至
A. 5个月
B. 6个月
C. 7个月
D. 8个月
E. 9个月

正确答案：B。6个月

解析：《执业医师法》规定对考核不合格的医师，县级以上人民政府卫生行政部门可以责令其暂停执业活动3～6个月（B对），并接受培训和继续医学教育，经考核仍不合格的，则注销注册，收回医师执业证书。